某脂肪酰CoA（20∶0）经β-氧化可分解为10mol乙酰CoA，此时可形成ATP的摩尔数为
A. 15
B. 25
C. 36
D. 45
E. 60

正确答案：C。36